急性风湿热合并消化性溃疡患者的首选药是
A. 利血平
B. 氧化镁
C. 碳酸氢钠
D. 青霉素
E. 红霉素

正确答案：D。青霉素

解析：本题考查青霉素。急性风湿热合并消化性溃疡患者的首选药是青霉素（D对）。风湿热与A组乙型溶血性链球菌有关，首选药物为青霉素，青霉素采用注射给药，不会对消化性溃疡患者产生不良反应。利血平（A错）适用于高血压及高血压危象。氧化镁（B错）能抑制和缓解胃酸过多，治疗胃溃疡和十二指肠溃疡病。碳酸氢钠（C错）中和胃酸作用迅速，但抗酸作用弱、持续时间短。红霉素（E错）不管是口服还是静脉滴注，对胃都有刺激，因此消化性溃疡患者不应服用。